牙周病全身治疗的常用药物不包括
A. 甲硝唑
B. 四环素
C. 羟氨苄青霉素
D. 螺旋霉素
E. 多种维生素

正确答案：E。多种维生素

解析：牙周病的全身治疗常用抗生素，因为主要致病因素是细菌，选用合适的抗生素，可杀灭侵入牙周袋组织内的微生物。掌握“慢性牙周炎的治疗原则、程序及方法”知识点。